7天的停药期，其中包括漏服的天数，然后再开始继续服用下一周期的药物。如果妇女漏服了药物，而且在随后的第一个正常停药间隔期未出现撤退性出血，则应考虑妊娠的可能性。【对发生胃肠道紊乱者的建议】部分注明如下内容：如果发生重度胃肠道紊乱，则吸收可能不完全，应采取额外的避孕措施。如果服用药物后3～4小时内发生呕吐，可以采用“漏服药的处理”参见【用法用量】的建议。如果妇女不想改变正常的服药计划，她必须从另一盒中取出药物补服。假如某女士在2017年5月15日20：00开始服用新一周期的药物，5月20日患者服用该药后3小时左右发生明显呕吐，对患者的用药建议是
A. 到21日20：00再同时服用两片药，然后在常规时间继续服药
B. 尽快补服一片，然后在常规时间继续服药
C. 尽快同时服用两片药，然后在常规时间续服药，在以后的7天内要加用屏障避孕法
D. 不再继续服用此周期药物，经过一个7天的停药期，再开始继续服用下一周期的药物
E. 尽快同时服用两片药，然后在常规时间继续服药，不需要使用额外的避孕措施

正确答案：B。尽快补服一片，然后在常规时间继续服药

解析：本题考查复方激素避孕药的使用。材料明确“如果服用药物后3～4小时内发生呕吐，可以采用“漏服药的处理”参见【用法用量】的建议”。该患者“5月15日20：00开始服用新一周期的药物，5月20日患者服用该药后3小时左右发生明显呕吐”，此情况应参照漏服药的处理建议，立即补服一片，下一片药物在常规时间服用（B对）。